男，35岁。高热、寒战、咳嗽3天。1周前曾因面部疖挤压排脓。查体：双肺呼吸音增强。血常规WBC18✕10⁹/L，N0.91，胸部X线片示两肺多发性圆形密度增高阴影。该患者最可能的诊断是
A. 吸入性肺脓肿
B. 肺淋巴瘤
C. 血源性肺脓肿
D. 肺血管炎
E. 肺真菌病

正确答案：C。血源性肺脓肿

解析：患者有面部疖挤压排脓病史（相关病史），高热、寒战、咳嗽3天（感染表现），血常规WBC 18✕10⁹/L，N0.91，胸部X线示两肺多发性圆形密度增高阴影（脓肿灶），结合上述病史、临床表现和实验室检查，患者最有可能的诊断是血源性肺脓肿（C对）。吸入性肺脓肿（A错）（P58）患者多有齿、口、咽喉的感染灶，或手术、醉酒和脑血管病等病史，炎症累及壁层胸膜可引起胸痛，且与呼吸有关，病变范围大时可出现气促，此外还有精神不振、全身乏力、食欲减退等全身中毒症状。肺淋巴瘤（B错）（P588）是由淋巴瘤转移到肺，以肺门及纵隔受累最多，多数有肺部浸润或胸腔积液，可致咳嗽、胸闷、气促、肺不张及上腔静脉压迫综合征等。血管炎是以血管壁的炎症性改变为主要病理表现的一组疾病，肺血管炎（D错）是指肺血管受侵犯的血管炎，临床上比较少见。肺真菌病（E错）（P54）是最常见的深部真菌病，临床表现无特异性，X线影像表现无特征性，病理学诊断是金标准。